用青霉素抗菌无作用的是
A. G+杆菌
B. 螺旋体
C. 流感杆菌
D. 病毒
E. 百日咳鲍特菌

正确答案：D。病毒

解析：青霉素G抗菌作用很强，在细菌繁殖期低浓度抑菌，较高浓度杀菌。对病原菌有高度抗菌活性：①大多数G+球菌；②G+杆菌；③G-球菌；④少数G-杆菌，如流感杆菌、百日咳鲍特菌等；⑤螺旋体、放线杆菌。对大多数G-杆菌作用较弱，对肠球菌不敏感，对真菌、原虫、立克次体、病毒等无作用。掌握“青霉素及头孢菌素类药”知识点。